从根本上消除或最大程度地减少有害因素的接触，例如：改变工艺和生产过程，制订职业接触限值，使作业环境达到卫生标准要求。这属于以下哪一类职业卫生预防工作
A. 初始级预防
B. 根本性预防
C. 第一级预防
D. 第二级预防
E. 第三级预防

正确答案：C。第一级预防